需放置一段时间后再灌注模型材料是
A. 琼脂类
B. 藻酸盐类
C. 聚醚橡胶类
D. A型硅橡胶
E. 缩合型硅橡胶

正确答案：D。A型硅橡胶

解析：加成型硅橡胶缺点：疏水（新的产品增加了亲水性），聚合后硬度较高，有的商品聚合后表面释放氢气，取印模后即刻灌注模型会在模型表面处产生蜂窝状气泡，需放置一段时间后再灌注模型。掌握“暂时冠及印模与模型”知识点。